旋光度测定法检查的杂质是
A. 硫酸阿托品中的莨菪碱
B. 硝酸士的宁中的马钱子碱
C. 盐酸吗啡中的罂粟酸
D. 硫酸奎宁中的其它生物碱
E. 盐酸麻黄碱中的有关物质

正确答案：A。硫酸阿托品中的莨菪碱

解析：本题考查药物中杂质的检查。旋光度测定法检查的杂质是硫酸阿托品中的莨菪碱（A对）。对于具有光学异构体的药物，如硫酸阿托品中的莨菪碱的检查可通过测定样品溶液的旋光度进行纯度检查：阿托品为外消旋体，无旋光性；莨菪碱为左旋体，有旋光性。在硝酸与水的混合液中反应的方法鉴别的杂质是硝酸士的宁中的马钱子碱（B错）。在酸性溶液中与三氯化铁试液反应的方法检查的杂质是盐酸吗啡中的罂粟酸（C错）。硫酸奎宁类的生物碱（D错）可通过绿奎宁反应来鉴别。盐酸麻黄碱中的有关物质（E错）通过在碱性条件下与硫酸铜的反应鉴别。